莲子与芡实具有的共同功效是
A. 活血化瘀
B. 养心安神
C. 固表止汗
D. 益肾固精
E. 敛肺止咳

正确答案：D。益肾固精

解析：莲子的功效为补脾止泻，止带，益肾涩精，养心安神。芡实的功效为益肾固精，补脾止泻，除湿止带。两药具有的共同功效是益肾固精（D对）。